心力衰竭时心肌收缩性降低的机制下列哪项不正确？
A. 兴奋-收缩耦联障碍
B. 心肌能量代谢紊乱
C. 心肌细胞凋亡
D. 心肌细胞坏死
E. 心肌交感神经分布密度增加

正确答案：E。心肌交感神经分布密度增加

解析：造成心衰的主要原因是心肌收缩性降低，其可以由心肌兴奋-收缩耦联障碍（A错）、心肌能量代谢紊乱（B错）、心肌收缩相关的蛋白改变引起。心肌细胞凋亡（C错）及坏死（D错）均可导致心肌收缩相关蛋白破坏使心肌收缩性降低。心肌交感神经分布密度增加（E对）不是心肌收缩性降低的机制。